锥体交叉的平面在
A. 脑桥
B. 中脑
C. 延髓
D. 中脑下丘
E. 脊髓

正确答案：C。延髓

解析：皮质脊髓束纤维在锥体下端，约75%-90%的纤维交叉至对侧的延髓（C对）锥体，形成锥体交叉，后经内囊后肢下行。